包合物的制备方法包括
A. 熔融法
B. 饱和水溶液法
C. 研磨法
D. 冷冻干燥法
E. 液中干燥法

正确答案：B、C、D。饱和水溶液法；研磨法；冷冻干燥法